妊娠合并急性病毒性肝炎肝郁脾虚证的治疗方剂为
A. 茵陈蒿汤
B. 胃苓汤
C. 逍遥散
D. 犀角地黄汤合黄连解毒汤
E. 栀子豉汤

正确答案：C。逍遥散

解析：妊娠合并急性病毒性肝炎肝郁脾虚证由于素体脾胃虚弱，或湿热内蕴，妊娠后阴血下聚养胎，肝血不足，肝之疏泄失常所致。治宜疏肝理气，健脾安胎，方用疏肝解郁，养血健脾的逍遥散加安胎之桑寄生、菟丝子（C对）。妊娠合并急性病毒性肝炎湿热蕴结证的治疗方剂为茵陈蒿汤（A错）；湿邪困脾证的治疗方剂为胃苓汤（B错）去桂枝、泽泻，加寄生、菟丝子；热毒内陷证的治疗方剂为犀角地黄汤合黄连解毒汤（D错）加茵陈、大青叶；栀子豉汤（E错）主要功效为清热除烦。